用IFN-α治疗毛细胞白血病
A. 应用生物应答调节剂进行免疫治疗
B. 应用细胞因子拮抗剂的治疗
C. 应用细胞因子的治疗
D. 过继免疫治疗
E. 应用抗体进行免疫治疗

正确答案：C。应用细胞因子的治疗